气管上端于第6颈椎处起于喉，向下到胸骨角平面分为左、右主支气管。关于气管隆嵴的叙述，下列哪项是正确的
A. 是气管黏膜皱襞
B. 是气管平滑肌向上的突嵴
C. 是气管杈内面的半月形隆嵴
D. 分叉处缺少气管软骨
E. 隆嵴以下的气管软骨环完整

正确答案：C。是气管杈内面的半月形隆嵴

解析：气管隆嵴是气管杈内面的半月形隆嵴（C对）。